根尖脓肿与骨膜下脓肿鉴别点是
A. 疼痛程度不同
B. 脓肿部位不同
C. 牙髓有无活力
D. 松动度的有无
E. 扪诊有无波动感

正确答案：E。扪诊有无波动感

解析：本题考查根尖脓肿与骨膜下脓肿的鉴别。根尖脓肿与骨膜下脓肿鉴别点是扪诊有无波动感（E对）。根尖脓肿与骨膜下脓肿是急性根尖周炎发展的两个不同的阶段，急性根尖周炎多因牙髓感染、坏死继发而来，故两者牙髓均无活力（C错）。根尖脓肿会有自发性.剧烈持续的跳痛，松动Ⅱ°～Ⅲ°；骨膜下脓肿疼痛更加剧烈，松动Ⅲ°，两者是有所不同，但疼痛程度（A错）的差别不大，且均有牙齿松动（D错）。根尖脓肿根尖部牙龈潮红，但位置深在，无明显肿胀，扪诊感轻微疼痛，无波动感；根尖脓肿由于脓液积聚于骨膜下，牙龈红肿，移行沟变浅扪诊深部有波动感，虽然两者脓肿部位也确有不同（B错），但是相比之下，扪诊有无波动感是其最明显的不同。